男性，62岁。近3个月来逐渐出现上腹不适，进食后饱胀，嗳气，纤维胃镜发现大弯侧胃壁上，1cm大小块状肿物，与周围组织界限较为清楚，病理提示恶性。该疾病治疗最关键是
A. 彻底清除淋巴结
B. 切除范围距肿瘤边缘6～9cm
C. 术后坚持化疗
D. 早诊早治
E. 设法保留部分胃底

正确答案：D。早诊早治

解析：老年男性患者，因上腹不适，进食后饱胀、嗳气来诊，纤维胃镜见大弯侧胃壁上lcm大小的块状肿物，与周围组织界限较为清楚，病理提示恶性，结合患者病史和胃镜检查，应考虑为BorrmannⅠ型进展期胃癌。早期胃癌术后5年生存率可达90％以上，其治疗效果和预后要明显好于进展期胃癌，因此对于胃癌治疗最关键的是早期诊断、早期治疗（D对）。按临床分期标准彻底清除淋巴结（A错）、切除范围距肿瘤边缘6～9cm（B错）、术后坚持化疗（C错）等可提高治疗效果，延长患者生存期，但均不是胃癌治疗的关键。根治性手术的原则为彻底切除胃癌原发灶，如果胃癌弥漫至胃底，应全部切除，不应保留（E错）。